地图舌的病损经常变换位置，移动或游走的原因主要是
A. 舌体的活动
B. 口腔PH值的变化
C. 细菌微生物的作用
D. 药物牙膏的作用
E. 剥脱区不断扩大

正确答案：E。剥脱区不断扩大

解析：本题考查地图舌、沟纹舌及舌乳头炎。地图舌当剥脱区以离心方向逐渐扩大时，其相应的白色边缘区也随之扩大或断离（E对），而使人们感到病损在移动或游走。